X线片表现为根尖周骨密度减低影像或根周膜影像模糊增宽为
A. 牙髓坏死
B. 牙髓钙化
C. 牙内吸收
D. 急性牙髓炎
E. 慢性根尖周炎

正确答案：E。慢性根尖周炎

解析：本题考查牙髓坏死、牙髓钙化与牙内吸收。慢性根尖周炎（E对）X线片表现为根尖周骨密度减低影像或根周膜影像模糊增宽。